造成体内外液体交换平衡失调钠、水潴留的机制哪项是不正确的？
A. GFR降低
B. 心房肽分泌减少
C. 肾小球滤过分数降低
D. 醛固酮分泌增多
E. ADH分泌增多

正确答案：C。肾小球滤过分数降低

解析：肾小球滤过率下降（A对），肾排钠排水减少引起水钠潴留。ANP能够减少肾素的分泌、抑制醛固酮、对抗血管紧张素的缩血管效应、拮抗醛固酮的滞Na＋作用，ANP分泌减少（B对）可导致水钠潴留。肾小球滤过分数降低（C错，为本题正确答案），无蛋白滤液相对减少，近曲小管重吸收钠和水也减少，不会导致水钠潴留。醛固酮促进肾脏保钠保水，醛固酮分泌增多（D对）引起水钠潴留。ADH促进远曲肾小管和集合管对钠水的重吸收，ADH分泌增多（E对）可引起水钠潴留。